颅骨锁骨发育不全，除了颅骨囟门不闭合和锁骨部分缺如等症状外，还有
A. 牙齿早萌
B. 牙齿先天缺失
C. 牙齿松动，自然脱落
D. 牙齿萌出困难
E. 牙齿易龋坏

正确答案：D。牙齿萌出困难

解析：颅骨锁骨发育不全，是一种常染色体显性遗传疾病，除牙齿萌出困难外，还伴有颅骨囟门不闭合和锁骨部分缺如等症状，这主要是遗传性成骨不全，牙槽骨重建困难，而缺乏恒牙的萌出潜力导致的。掌握“迟萌、多生牙和融合牙”知识点。